根据《中华人民共和国药品管理法》，关于药品采购的说法，错误的是
A. 药店可以从具有药品生产资质的企业购进药品
B. 医疗机构可以从具有药品生产资质的企业购进药品
C. 药品生产企业可以从另一家具有药品生产资质的企业购进原料药
D. 药品批发企业可以从农村集贸市场购进没有实施批准文号管理的地产中药材
E. 药品批发企业可以从农村集贸市场购进没有实施批准文号管理的中药饮片

正确答案：E。药品批发企业可以从农村集贸市场购进没有实施批准文号管理的中药饮片

解析：本题考查药品的采购。药品生产企业、药品经营企业、医疗机构必须从具有药品生产、经营资格的企业购进药品，但是，购进没有实施批准文号管理的中药材除外。城乡集市贸易市场不得出售中药材以外的药品，持有《药品经营许可证》的药品零售企业在规定的范围内可以在城乡集市贸易市场设点出售中药材以外的药品（E错，为本题正确答案）。